国家实行特殊管理的药品是
A. 白蛋白
B. 福尔可定
C. 头孢哌酮
D. 氧氟沙星
E. 鱼腥草注射液

正确答案：A、B。白蛋白；福尔可定

解析：本题考查的是药品和药品分类。国家实行特殊管理的药品是白蛋白（A对）、福尔可定（B对）。药品和药品分类：《药品管理法》规定，药品是指“用于预防、治疗、诊断人的疾病，有目的地调节人的生理机能并规定有适应症或者功能主治、用法和用量的物质，包括中药、化学药和生物制品等”。从该定义来看，我国《药品管理法》中规定的药品具有特定的内涵和外延。药品特指人用药品，不包括兽药和农药。药品的使用目的、方法有严格规定。使用目的是用于预防、治疗、诊断人的疾病，有目的地调节人的生理机能；使用方法要求必须遵循规定的适应症或者功能主治、用法和用量。根据药品的定义，药品可分为中药、化学药和生物制品三类。同时，《药品管理法》有关条文对药品进行了其他分类。《药品管理法》第四条：“国家发展现代药和传统药”；第五十四条：“国家对药品实行处方药与非处方药分类管理制度”；第六十一条：“疫苗、血液制品、麻醉药品、精神药品、医疗用毒性药品、放射性药品、药品类易制毒化学品等国家实行特殊管理的药品不得在网络上销售”。根据相关条文，药品在一定程度上还可分为现代药和传统药；处方药与非处方药；实行一般管理的药品与实行特殊管理的药品。另外，在药品注册管理中，对中药、化学药和生物制品等按药品注册类别进行分类。中药注册分类：中药创新药，中药改良型新药，古代经典名方中药复方制剂，同名同方药等。化学药注册分类：化学药创新药，化学药改良型新药，仿制药等。生物制品注册分类：生物制品创新药、生物制品改良型新药，已上市生物制品（含生物类似药）等。血液制品，是特指各种人血浆蛋白制品，包括人血白蛋白、人胎盘血白蛋白、静脉注射用人免疫球蛋白、肌注人免疫球蛋白、组织胺人免疫球蛋白、特异性免疫球蛋白、免疫球蛋白（乙型肝炎、狂犬病、破伤风免疫球蛋白）、人凝血因子Ⅷ、人凝血酶原复合物、人纤维蛋白原、抗人淋巴细胞免疫球蛋白等。麻醉药品目录：《麻醉药品品种目录（2013版）》共121个品种，其中我国生产及使用的品种及包括的制剂、提取物、提取物粉共有27个品种，具体有以下品种。1.可卡因；2.罂粟浓缩物（包括罂粟果提取物、罂粟果提取物粉）；3.二氢埃托啡；4.地芬诺酯；5.芬太尼；6.氢可酮；7.氢吗啡酮；8.美沙酮；9.吗啡（包括吗啡阿托品注射液）；10.阿片（包括复方樟脑酊、阿桔片）；11.羟考酮；12.哌替啶；13.瑞芬太尼；14.舒芬太尼；15.蒂巴因；16.可待因；17.右丙氧芬；18.双氢可待因；19.乙基吗啡；20.福尔可定；21.布桂嗪；22.罂粟壳。需要说明的有两点，一是上述品种包括其可能存在的盐和单方制剂（除非另有规定）；二是上述品种包括其可能存在的化学异构体及酯、醚（除非另有规定）。《条例》规定，麻醉药品目录中的罂粟壳只能用于中药饮片和中成药的生产以及医疗配方使用。